依照《处方药与非处方药流通管理暂行规定》，药品生产、批发企业向药品零售企业和医疗机构销售处方药和非处方药，必须遵循的原则和规定是
A. 分类管理、分类销售
B. 分级管理、分类销售
C. 分类管理、分级销售
D. 分别管理、分类销售
E. 分类管理、分别销售

正确答案：A。分类管理、分类销售

解析：本题考查生产、批发企业销售处方药与非处方药的管理。依照《处方药与非处方药流通管理暂行规定》，药品生产、批发企业向药品零售企业和医疗机构销售处方药和非处方药，必须遵循的原则和规定是分类管理、分类销售（A对）。《处方药与非处方药流通管理暂行规定》第二章生产、批发企业销售第六条：药品生产、批发企业必须按照分类管理、分类销售的原则和规定向相应的具有合法经营资格的药品零售企业和医疗机构销售处方药和非处方药，并按有关药品监督管理规定保存销售记录备查。